在注射白喉抗毒素的同时也做白喉类毒素接种属于
A. 自然自动免疫
B. 自然被动免疫
C. 人工自动免疫
D. 人工被动免疫
E. 被动自动免疫

正确答案：E。被动自动免疫